下列那项不是葡萄胎的临床表现
A. 闭经
B. 不规则阴道流血
C. 子宫异常增大
D. 甲状腺功能低下
E. 黄素囊肿

正确答案：D。甲状腺功能低下

解析：葡萄胎发生时临床表现为甲状腺功能亢进现象（D错，为本题正确答案）、停经（A对）、不规则阴道流血（B对）、下腹痛、子宫异常增大变软（C对）、妊娠呕吐及子痫前期征象、贫血与感染。体征为在双侧附件处，多数可扪及大小不等、活性的囊性肿物，即卵巢黄素化囊肿（E对）。